年轻女性月经增多，疑有缺铁性贫血，哪项检查最有诊断意义
A. 血清铁降低
B. 总铁结合力增高
C. 血清可溶性转铁蛋白受体降低
D. 游离原卟啉降低
E. 铁盐吸收降低

正确答案：C。血清可溶性转铁蛋白受体降低

解析：血清可溶性转铁蛋白受体（sTfR）测定是迄今反应缺铁性红细胞生成的最佳指标，一般sTfR浓度＞26.5nmol/L（2.25μg/ml）可诊断缺铁。掌握“贫血概论及缺铁性贫血”知识点。